以下关于增强子的叙述错误是
A. 增强子决定基因表达的组织特异性
B. 增强子是远离启动子的顺式作用元件
C. 增强子作用无方向性
D. 增强子在基因的上游或下游均对基因的转录有增强作用
E. 增强子只在个别真核生物中存在，无普遍性

正确答案：E。增强子只在个别真核生物中存在，无普遍性